乳腺纤维腺瘤外观常见的肉眼特点
A. 息肉状
B. 乳头状
C. 分叶状
D. 结节状
E. 囊状

正确答案：D。结节状

解析：乳腺纤维腺瘤外观的肉眼特点常呈圆形或卵圆形结节状（D对）。起源于上皮组织的肿瘤（P96-P97）常呈乳头状（B错）、息肉状（A错）、蕈伞状或菜花状。脂肪瘤（P98）、脂肪肉瘤（P99）等常呈分叶状（C错）。囊状（E错）可见于囊腺癌等。